根据《国家基本药物目录管理办法》，在国家基本药物目录遴选时应经过单独论证的是
A. 根据药物经济学评价可被成本效益比更优的品种所替代的药品
B. 有效性和安全性证据明确、成本效益比现有基本药物更优的药品
C. 除急救、抢救用药外的独家生产药品品种
D. 主要用于滋补保健作用、易滥用的药品

正确答案：C。除急救、抢救用药外的独家生产药品品种

解析：本题考查的是国家基本药物目录的制定。根据《国家基本药物目录管理办法》，在国家基本药物目录遴选时应经过单独论证的是除急救、抢救用药外的独家生产药品品种（C对）。国家基本药物目录的制定：国家卫生健康委员会会同有关部门起草国家基本药物目录遴选工作方案和具体的遴选原则，经国家基本药物工作委员会审核后组织实施。国家基本药物遴选应当按照防治必需、安全有效、价格合理、使用方便、中西药并重、基本保障、临床首选和基层能够配备的原则，结合我国用药特点，参照国际经验，合理确定品种（剂型）和数量。国家基本药物应当是《中华人民共和国药典》收载的，国家卫生健康部门、国家药品监督管理部门颁布药品标准的品种。除急救、抢救用药外，独家生产品种纳入国家基本药物目录应当经过单独论证。下列药品不纳入国家基本药物目录遴选范围：①含有国家濒危野生动植物药材的；②主要用于滋补保健作用，易滥用的（D错）；③非临床治疗首选的；④因严重不良反应，国家药品监督管理部门明确规定暂停生产、销售或使用的；⑤违背国家法律、法规，或不符合伦理要求的；⑥国家基本药物工作委员会规定的其他情况。国家基本药物目录的调整：基本药物目录管理采取以下举措：一是坚持防治必需，以满足疾病防治基本用药需求为导向，基本药物品种数量能够满足常见病、慢性病、应急抢救等主要临床需求，以及儿童等特殊人群和公共卫生防治用药需求。二是强化循证决策，调入和调出并重，突出药品临床价值，以诊疗规范、临床诊疗指南和专家共识为依据，优先调入有效性和安全性证据明确、成本效益比显著的药品品种（B错）。重点调出已退市的，发生严重不良反应较多、经评估不宜再作为基本药物的，以及有风险效益比或成本效益比更优的品种替代的药品。三是动态调整目录，对基本药物目录定期评估，动态调整，调整周期原则上不超过3年。对新审批上市、疗效有显著改善且价格合理的药品，可适时启动调入程序。除少数民族地区可增补少量民族药外，原则上各地不增补药品。四是加强上下级医疗机构的用药衔接，适应分级诊疗制度建设需求，推进市（县）域内公立医疗机构集中带量采购，规范基本药物采购的品种、剂型、规格，满足群众需求。国家基本药物目录的品种和数量调整应当根据以下因素确定：①我国基本医疗卫生需求和基本医疗保障水平变化；②我国疾病谱变化；③药品不良反应监测评价；④国家基本药物应用情况监测和评估；⑤已上市药品循证医学、药物经济学评价；⑥国家基本药物工作委员会规定的其他情况。属于下列情形之一的品种，应当从国家基本药物目录中调出：①药品标准被取消的；②国家药品监督管理部门撤销其药品批准证明文件的；③发生严重不良反应，经评估不宜作为国家基本药物使用的；④根据药物经济学评价，可被风险效益比或成本效益比更优的品种所替代的（A错）；⑤国家基本药物工作委员会认为应当调出的其他情形。